患者，女，80岁，高血压病史28年，近日自觉憋气，昨夜出现呼吸困难，不能平躺，喘憋，咳粉红色泡沫样痰，诊断为心力衰竭。应选用的药物是
A. 胺碘酮
B. 氟桂利嗪
C. 硝酸异山梨酯
D. 呋塞米
E. 氨氯地平

正确答案：D。呋塞米

解析：本题考查呋塞米。应选用的药物是呋塞米（D对）。利尿剂可减轻心脏负荷，呋塞米对轻度心衰患者从小剂量开始进行给药，逐渐加量，静脉注射效果优于口服。胺碘酮（A错）为转复房颤的药物。氟桂利嗪（B错）用于脑供血不足，椎动脉缺血，脑血栓形成；耳鸣，脑晕；偏头痛预防；癫痫辅助治疗。硝酸异山梨酯（C错）用于冠心病的长期治疗，心绞痛的预防，心肌梗死后持续心绞痛的治疗；与洋地黄和（或）利尿剂联合应用，治疗慢性充血性心力衰竭，肺动脉高压的治疗。氨氯地平（E错）为二氢吡啶类抗高血压药物，适用于老年高血压、单纯收缩期高血压，伴稳定型心绞痛、冠状动脉或颈动脉粥样硬化及周围血管病患者。